肾衰竭失代偿期Ccr值为
A. 120-80ml/min
B. ＜10ml/min
C. 19-10ml/min
D. 50-20ml/min
E. 80-51ml/min

正确答案：D。50-20ml/min

解析：根据内生肌酐清除率（Ccr）一般可将肾功能分为4期：肾衰竭代偿期Ccr为80-51ml/min（E错）；肾衰竭失代偿期Ccr为50-20ml/min（D对）；肾衰竭期Ccr为19-10ml/min（C错）；肾衰竭终末期为＜10ml/min（B错）。